患者男性，63岁，颊癌术后7年，术后曾行颈部及颌下区放疗，剂量不详。3个月前行出现下颌牙龈溃疡，经久未愈且局部骨外露伴下颌区域针刺剧痛。此患者可能的诊断放射性颌骨坏死,为对此患者疾病治疗有意义的方法是
A. 高压氧治疗
B. 局部放疗
C. 全身化疗
D. 射频治疗
E. 切开引流

正确答案：A。高压氧治疗

解析：本题考查放射性骨髓炎的治疗。放射性骨坏死的全身治疗，应用抗菌药物控制感染，镇痛剂镇痛，积极加强营养，输血、高压氧治疗有积极意义（A对）；局部治疗中，死骨未分离前，为控制感染，每天使用低浓度过氧化氢溶液冲洗；摘除分离死骨，将残留病灶清除干净，防止复发。